激活的CTL使靶细胞裂解的主要因素是
A. 颗粒酶
B. IL-12
C. 穿孔素﹢颗粒酶﹢FasL
D. IFN-γ
E. Fas

正确答案：C。穿孔素﹢颗粒酶﹢FasL